关于乳牙牙龈瘘道的描述，以下正确的是
A. 乳牙慢性根尖周炎在患牙附近都会出现瘘道孔
B. 瘘道孔可出现在患牙根周两侧龈黏膜上，也可能出现在患牙根分歧部位
C. 瘘道孔不断流脓，瘘道出现后就不会封闭
D. 瘘道的出现即表明患牙牙髓完全坏死
E. 出现瘘道的患牙可试行牙髓切断术治疗

正确答案：B。瘘道孔可出现在患牙根周两侧龈黏膜上，也可能出现在患牙根分歧部位

解析：本题考查乳牙牙龈瘘道。由于颊侧骨壁薄，乳牙牙髓坏死时常侵及颊侧骨壁，在颊侧黏膜出现瘘道孔，也可能出现在患牙舌、腭侧牙龈黏膜上。髓室底薄且副孔副根管多，牙髓感染后易通过髓底副根管和副孔侵犯根分歧（B对）。乳牙慢性根尖周炎常在患牙附近出现瘘道孔，此为有瘘型慢性根尖周炎，但也有部分患者无明显自觉症状，并非乳牙慢性根尖周炎均可在患牙附近出现瘘道（A错）。瘘道孔处不断流脓，为感染牙髓坏死化脓所致，经过及时的乳牙根管治疗，开髓引流，彻底去除坏死牙髓，切除坏死瘘道组织，仍可使根尖周病变愈合，使瘘道封闭（C错）。单根乳牙牙龈肿胀或出现瘘管时，牙髓多完全坏死，多根的乳牙可能出现某一两根牙髓坏死而其他根管内可能仍为活髓或残留活髓（D错）。乳牙牙髓切断术（E错）是在局麻下去除冠方牙髓组织，用药物处理牙髓创面以保存根部健康牙髓组织的治疗方法。适用于乳牙深龋或外伤露髓不能进行直接盖随者；乳牙部分冠髓牙髓炎。乳牙瘘道的形成多由乳牙根尖周炎所致应试行乳牙根管治疗。